某女，43岁，入睡困难，且多梦易醒，心悸健忘，精疲食少，四肢倦怠，腹胀便溏，面色少华，舌质淡，苔薄白，脉细无力，中医诊断为不寐治疗宜选用的方剂是
A. 逍遥散
B. 归脾汤
C. 导赤散
D. 右归丸
E. 生脉散

正确答案：B。归脾汤

解析：本题考查的是不寐的辨证论治。入睡困难，且多梦易醒，心悸健忘，精疲食少，四肢倦怠，腹胀便溏，面色少华，舌质淡，苔薄白，脉细无力，中医诊断为不寐治疗宜选用的方剂是归脾汤（B对）。不寐心脾两虚证：【症状】不易入睡，多梦易醒，心悸健忘，神疲食少，伴头晕目眩，四肢倦怠，腹胀便溏，面色少华。舌淡苔薄，脉细无力。【方剂应用】基础方剂为归脾汤（人参、黄芪、白术、茯神、龙眼肉、酸枣仁、木香、当归、远志、甘草、生姜、大枣）加减。逍遥散（A错）为经前后诸证肝郁肾虚证方剂应用。经前后诸证肝郁肾虚证：【症状】经断前后，阵发性烘热汗出，腰膝酸软，烦躁易怒，情绪异常，头晕耳鸣，乳房胀痛，月经紊乱，或胸闷善太息。舌淡红或偏暗，苔薄白，脉弦细。【方剂应用】基础方剂为一贯煎（北沙参、麦冬、当归、生地黄、枸杞子、川楝子）合逍遥散（柴胡、当归、白芍、白术、茯苓、甘草、薄荷、煨姜）加减。导赤散（C错）为口疮心脾积热证的中成药应用。口疮心脾积热证：【症状】口腔黏膜溃疡，灼痛明显，常因过食煎炒辛辣或少寐而发，伴口渴心烦、失眠、小溲短黄、大便秘结；检查见口腔黏膜表面有黄白色假膜，周边红肿。舌红，苔黄或腻，脉数有力。【中成药应用】常用中成药有牛黄清胃丸、导赤丸。右归丸（D错）为肾虚腰痛的方剂应用。肾虚腰痛：【症状】腰部隐隐作痛，酸软无力，劳则加重，卧则减轻，或伴有耳鸣耳聋。偏于肾阴虚者，兼有手足心热，潮热盗汗，口燥咽干，舌红少苔，脉细数；偏于肾阳虚者，兼有腰部冷痛，得热则舒，肢冷畏寒，面色㿠白，舌淡胖有齿痕，脉沉细无力。【方剂应用】基础方剂为：偏于肾阴虚者，以左归丸（熟地黄、山药、枸杞子、山茱萸、川牛膝、菟丝子、鹿角胶、龟板胶）加减。偏于肾阳虚者，以右归丸（熟地黄、山药、山茱萸、枸杞子、菟丝子、鹿角胶、杜仲、肉桂、当归、制附子）加减。生脉散（E错）为胸痹气阴两虚的方剂应用。胸痹气阴两虚证：【症状】胸闷隐痛，时作时止，心悸气短，动则益甚，伴倦怠懒言，易汗出，头晕，失眠多梦。舌红或淡红，舌体胖且边有齿痕，苔薄白或少，脉细缓或结代。【方剂应用】基础方剂为生脉散（人参、麦冬、五味子）合人参养荣汤（人参、熟地黄、当归、白芍、白术、茯苓、黄芪、陈皮、五味子、桂心、远志、炙甘草）加减。